用于治疗抗精神病药引起的锥体外系反应的药物是
A. 氟哌啶醇
B. 丙米嗪
C. 芬太尼
D. 氯氮平
E. 苯海索

正确答案：E。苯海索